子宫肌瘤药物治疗原则
A. 年轻要求生育者
B. 绝经前妇女肌瘤不很大，症状较轻
C. 身体虚弱不能手术者
D. 有手术禁忌证，要治疗后手术
E. 以上均是

正确答案：E。以上均是

解析：年轻要求保留生育功能者（A对）。生育年龄因肌瘤所致不孕或流产，药物治疗后使肌瘤萎缩促使受孕，胎儿成活。绝经前妇女，肌瘤不很大，症状亦轻（B对），应用药物后，使子宫萎缩绝经，肌瘤随之萎缩而免于手术。有手术指征，但目前有禁忌症需要治疗后方可手术者（D对）。患者合并内科、外科疾病不能胜任手术或不愿手术者（C对）（E对）。